肝脓肿的特点正确的是
A. 细菌性肝脓肿常为单发，较大
B. 阿米巴肝脓肿起病急，伴寒战，高热
C. 阿米巴肝脓肿较小，多为多发性
D. 阿米巴肝脓肿脓液为褐色，无臭味
E. 阿米巴肝脓肿病人粪便可找到阿米巴原虫

正确答案：D。阿米巴肝脓肿脓液为褐色，无臭味

解析：阿米巴肝脓肿脓液由坏死性物质和陈旧血液混合而成，为无菌性液化性坏死，不产生有臭味的细菌代谢物，褐色，无臭味（D对）。细菌性肝脓肿一般为多个小脓腔，而非单发、较大的脓腔（A错）。阿米巴肝脓肿起病缓慢，局部炎症反应轻微，通常表现为长期不规则发热，鲜有寒战，高热（B错）。阿米巴肝脓肿一般为单发脓肿，脓腔较大（C错）。阿米巴肝脓肿病人粪便中可找到阿米巴滋养体或包囊，而不是原虫（E错）。